治疗小儿口疮脾胃积热证，应首选
A. 清胃散
B. 清热泻脾散
C. 六味地黄丸
D. 泻心导赤汤
E. 凉膈散

正确答案：E。凉膈散

解析：清胃散功能清胃凉血，主治胃火牙痛证（A错）。清热泻脾散功能清心泻脾，为鹅口疮心脾积热证的选方（B错）。六味地黄丸功能滋补肝肾，为口疮虚火上浮证的选方（C错）。泻心导赤散功能清心凉血，泻火解毒，为治疗口疮心火上炎证的选方（D错）。凉膈散功能泻火通便，清上泄下，为治疗中、上二焦火热炽盛证的常用方，可用于治疗口疮脾胃积热证（E对）。